《中国药典》规定，含量测定指标成分相同的药材是
A. 麻黄与黄连
B. 苦参与山豆根
C. 延胡索与防己
D. 大黄与芦荟
E. 虎杖与何首乌

正确答案：B。苦参与山豆根

解析：本题考查苦参与山豆根的生物碱类型。双稠哌啶类：由两个哌啶环共用一个氮原子稠合而成的杂环，具喹诺里西啶的基本母核。主要分布于豆科、石松科和千屈菜科。如苦参中的苦参碱、氧化苦参碱，野决明中的金雀花碱等。山豆根中的主要生物碱及其化学结构 生物碱是山豆根的主要活性成分，其生物碱大多属于喹诺里西啶类。其中以苦参碱和氧化苦参碱为主（B对）。麻黄中含有多种生物碱，以麻黄碱和伪麻黄碱为主。黄连的有效成分主要是生物碱，已经分离出来的生物碱有小檗碱、巴马汀、黄连碱、甲基黄连碱、药根碱和木兰碱等（A错）。延胡索含有多种苄基异喹啉类生物碱，包括延胡索甲素、延胡索乙素和去氢延胡索甲素等。防己的有效成分为生物碱，其中包括汉防己甲素和汉防己乙素（C错）。大黄中含游离型和结合型蒽醌类衍生物，还含鞣质类、二苯乙烯苷类、苯酚苷类和苯丁酮类成分等。芦荟中主要活性成分是羟基蒽醌类衍生物，包括芦荟大黄素、大黄酸、大黄素、大黄酚、大黄素甲醚等。《中国药典》以芦荟苷为指标成分进行含量测定（D错）。虎杖主要含有蒽醌类化合物，此外还含有二苯乙烯类、黄酮类、水溶性多糖和鞣质等成分。何首乌的主要成分为蒽醌类成分，以大黄素、大黄酚、大黄素甲醚、大黄酸、芦荟大黄素等为主，《中国药典》以二苯乙烯苷和结合蒽醌为指标成分对何首乌进行含量测定（E错）。